男，40岁，查见松动I度，右上6（牙合）面深龋，颊侧近中探及深达根尖的牙周袋，探之溢脓，叩（-），X-ray示牙槽骨高度基本正常，根尖区阴影。初诊印象考虑原因可能为
A. 牙周脓肿
B. 牙龈脓肿
C. 咬合创伤
D. 慢性根尖周炎
E. 牙髓牙周联合病变

正确答案：E。牙髓牙周联合病变

解析：本题考查牙髓-牙周联合病变。牙髓牙周联合病变是指同一个牙齿有各自的牙髓病变和牙周病变，根尖区有阴影说明有慢性根尖周炎，还有深牙周袋和牙周溢脓，所以该患者既有牙周的病变又有牙髓的病变（E对）。患者有深牙周袋，说明有牙周病变，牙龈炎症不会造成深牙周袋（B错）。牙周脓肿X线有牙槽骨吸收（A错）。咬合创伤叩痛明显（C错）。慢性根尖周炎X线上根尖区有阴影，该患者为慢性根尖周炎的急性发作，因为伴有牙周袋和溢脓，所以不单纯是根尖周病变，还有伴随的牙周病变（D错）。